脂溶性中等，作用持续3～6h的药物是
A. 巴比妥
B. 硫喷妥
C. 苯巴比妥
D. 戊巴比妥
E. 司可巴比妥

正确答案：D。戊巴比妥

解析：本题考查巴比妥类药物。脂溶性中等，作用持续3～6h的药物是戊巴比妥（D对）；巴比妥（A错）脂溶性低，作用时间长；硫喷妥（B错）与戊巴比妥相比，脂溶性增加，易透过血脑屏障，持续时间很短，为1小时左右；苯巴比妥（C错）脂溶性较高，不易被代谢而易被重吸收，作用时间长，为4～12小时；司可巴比妥（E错）脂溶性比戊巴比妥高，为短效型催眠药，作用时间为1～4小时。